下列哪项不属于肾病综合征的并发症
A. 感染
B. 血栓和栓塞并发症
C. 急性肾衰竭
D. 脂肪代谢紊乱
E. 高血糖

正确答案：E。高血糖

解析：肾病综合征并发症为：感染；血栓和栓塞并发症；急性肾衰竭；脂肪代谢紊乱导致心血管并发症。而高血糖并不是其并发症。掌握“慢性肾小球肾炎、肾病综合征”知识点。